红花具有的功效是
A. 活血行气，祛风止痛
B. 活血行气，清心凉血
C. 活血调经，除烦安神
D. 活血通经，清热解毒
E. 活血通经，祛瘀止痛

正确答案：E。活血通经，祛瘀止痛

解析：该题考查红花的功效。红花味辛，性温，入心、肝经，其功效为活血通经，祛瘀止痛（E对）。